患儿童某，男，9岁，上颌多个牙龋坏、脱落，要求治疗。检查：口腔卫生差，左右上Ⅳ缺失，Ⅴ残根，根尖外露，左右上6无龋。间隙管理最好采用
A. 远中导板间隙保持器
B. 丝圈式间隙保持器
C. 充填式间隙保持器
D. Nance腭弓式间隙保持器
E. 舌弓式间隙保持器

正确答案：D。Nance腭弓式间隙保持器

解析：本题考查Nance腭弓式间隙保持器的适应证。患儿左右上颌第一乳磨牙缺失，第二乳磨牙残根，第一恒磨牙无龋存在，适用于Nance腭弓式间隙保持器（D对），它是将腭弓的两端固定在第二乳磨牙或第一恒磨牙上，以保持牙弓周长和牙齿间隙的保持器。远中导板间隙保持器（A错）适用于第二乳磨牙早失，第一恒磨牙尚未萌出或萌出中的病例。丝圈式间隙保持器（B错）适用于单侧第一磨牙早失或第一恒磨牙萌出后，第二乳磨牙单侧早期丧失的病例，亦或是双侧乳磨牙早失，用其他间隙保持器装置困难的病例。充填式间隙保持器（C错）适用于单个乳磨牙早失，间隙前端的牙齿有远中邻面龋，或后端的牙齿有近中邻面龋，龋坏均波及牙髓需作根管治疗者。舌弓式间隙保持器（E错）与Nance腭弓式间隙保持器的用途一致，是一种用于下颌的保持器。